研究一种病在一个单位内的传播能力时用
A. 死亡率
B. 患病率
C. 发病率
D. 续发率

正确答案：D。续发率

解析：本题考查续发率的用途。续发率（D对）可用于比较传染病传染力的强弱，分析传染病流行因素及评价卫生防疫措施的效果。死亡率（A错）是反映一个人群总死亡水平的指标；患病率（B错）通常用来反映疾病的现患状况，对于病程较长的慢性病，可反映其流行情况；发病率（C错）是疾病流行强度的指标。